人体与病原体处于相持状态，不出现临床症状，不排出病原体
A. 病原体被消灭或排出体外
B. 病原携带状态
C. 隐性感染
D. 潜在性感染
E. 显性感染

正确答案：D。潜在性感染

解析：潜伏性感染又称潜在性感染。病原体感染人体后，寄生于某些部位，由于机体免疫功能足以将病原体局限化而不引起显性感染，但又不足以将病原体清除时（E错），病原体便可长期潜伏起来（D对）。显性感染又称临床感染，是指病原体侵人人体后，不但诱导机体发生免疫应答，而且，通过病原体本身的作用或机体的变态反应，导致组织损伤，引起病理改变和临床表现（A错）。隐性感染又称亚临床感染，是指病原体侵入人体后，仅诱导机体产生特异性免疫应答，而不引起或只引起轻微的组织损伤，因而在临床上不显出任何症状、体征甚至生化改变，只能通过免疫学检查才能发现传染病学（B错）。病原携带状态是指病原体侵入人体后，可以停留在入侵部位，或侵入较远的脏器继续生长、繁殖，而人体不出现任何的疾病状态，但能携带并排除病原体，成为传染病流行的传染源（C错）。